构成牙体组织主体的结构是
A. 牙髓
B. 牙本质
C. 牙骨质
D. 牙釉质
E. 以上都不是

正确答案：B。牙本质

解析：牙本质构成牙齿的主体。牙本质色淡黄，稍有弹性，硬度比釉质低，比骨组织略高。成熟牙本质重量的70%为无机物，有机物为20%，水为10%。如按体积计算，无机物、有机物和水分的含量约为50%、30%和20%。牙本质的无机物主要也为磷灰石晶体，但其晶体比牙釉质中的小，与骨和牙骨质中的相似。微量元素有碳酸钙、氟化物、镁、锌、金属磷酸盐和硫酸盐。掌握“牙本质”知识点。